男，30岁。1小时前从3米高处坠落，右腰部受伤，局部疼痛，肉眼血尿。查体：生命体征平稳，腹软。住院5日后下床活动，右腰部疼痛加剧并出现腰部包块。此时P120次/分，BP80/40mmHg。为了解右腰部包块来源，应采用的检查是
A. 同位素肾图
B. B超
C. KUB
D. 血常规
E. 尿常规

正确答案：B。B超

解析：青年男性患者，右腰部受伤，出现局部疼痛和肉眼血尿（肾脏损伤的表现），应考虑右肾损伤。患者受伤当日生命体征平稳，但5日后下床活动，右腰部疼痛加剧并出现腰部包块，血压下降，脉率/收缩压=120/80=1.5，提示有休克，考虑有肾脏内大量出血，故腰部包块最可能是大量出血所致血肿，为了解其来源明确诊断，应采用的检查是B超（B对），超声对液体显示效果最佳，表现为液性暗区。同位素肾图（P517）（A错）主要用于测定肾小管分泌功能和显示上尿路有无梗阻。KUB（P516）（C错）即尿路平片，可用于判断泌尿系结石的来源，对肾损伤的诊断意义不大。血常规（D错）和尿常规（E错）可用于提示肾脏有无活动性出血，但对包块来源诊断价值不大。